决定细菌耐药性的基因是
A. F因子
B. R质粒
C. Vi质粒
D. Col质粒
E. r决定因子

正确答案：E。r决定因子

解析：r决定因子可以表达耐药基因。掌握“细菌遗传变异的物质基础及机制”知识点。